网膜囊
A. 借网膜孔与腹膜腔相通
B. 前壁是肝和胃
C. 左侧壁是左肾和胰
D. 下壁是肠系膜
E. 后壁是大网膜

正确答案：A。借网膜孔与腹膜腔相通

解析：网膜囊借网膜孔与腹膜腔相通(A对)，前壁为小网膜、胃后壁的腹膜及胃结肠韧带(B错)，左侧为脾、胃脾韧带和脾肾韧带(C错)，下壁为大网膜前后两层愈着处(D错)，后壁为横结肠及其系膜和覆盖在胰、左肾、左肾上腺等处的系膜(E错)。